几种毒物同时作用，其毒物毒性等于各毒物分别作用的毒性总和，叫
A. 联合作用
B. 相加作用
C. 相乘作用
D. 拮抗作用
E. 独立作用

正确答案：B。相加作用